上斜肌收缩时，使瞳孔转向
A. 内侧
B. 内下方
C. 外下方
D. 外上方
E. 内上方

正确答案：C。外下方

解析：上斜肌收缩时，使瞳孔转向外下方（C对）。使瞳孔转向内侧（A错）的是内直肌；使瞳孔转向内下方（B错）的是下直肌；使瞳孔转向外上方（D错）的是下斜肌；使瞳孔转向内上方（E错）的是上直肌。